医学研究伦理的要求除外
A. 动机纯正
B. 诚实严谨
C. 敢于怀疑
D. 公正无私
E. 知识保密

正确答案：E。知识保密